女，28岁。停经3个月，早孕反应消失，阴道少许流血2天。妇科检查：宫口闭，子宫如妊娠8周大，质软，双侧附件区未触及异常。该患者正确的处理措施是
A. 继续观察1周
B. 孕激素保胎治疗
C. 静脉滴注缩宫素引产
D. 雌激素治疗后刮宫
E. 孕激素治疗后刮宫

正确答案：D。雌激素治疗后刮宫

解析：该孕妇28岁，停经3个月，早孕反应消失，阴道少许流血2天（稽留流产表现为早孕反应消失，有先兆流产症状或无任何症状，先兆流产主要表现为停经后阴道少量流血和阵发性腹痛），宫口闭（稽留流产妇科检查宫颈口未开），子宫如妊娠8周大（稽留流产子宫小于停经周数，但大于正常非孕子宫），双侧附件区未触及异常，最可能诊断为稽留流产。处理前应查血常规、血小板计数及凝血功能，并做好输血准备。若凝血功能正常则行雌激素治疗，以提高子宫肌对缩宫素的敏感性。若子宫＜12周孕者，可行刮宫术，术中肌内注射缩宫素，现子宫如妊娠8周大，则应行刮宫术，故正确的处理措施是雌激素治疗后刮宫（D对）；子宫＞12孕周者可静脉滴注缩宫素引产（C错）。